疲劳的确切定义应该是
A. 正常的心理反应
B. 正常的生理反应
C. 正常的精神反应
D. 体力和脑力工作效率暂时的降低
E. 倦怠的感觉

正确答案：D。体力和脑力工作效率暂时的降低